乙药厂生产的某药品含量明显低于国家药品标准，对人体健康造成严重危害，构成犯罪，其罪名应定为
A. 生产、销售假药罪
B. 生产、销售劣药罪
C. 生产、销售伪劣商品罪
D. 虚假广告罪
E. 非法经营罪

正确答案：B。生产、销售劣药罪

解析：本题考查药品安全法律责任。根据《药品管理法》第九十八条第三款规定，药品成分的含量不符合国家药品标准的为劣药。乙药厂生产的某药品含量明显低于国家药品标准，对人体健康造成严重危害，构成犯罪，其罪名应定为生产、销售劣药罪（B对）。